几乎不能通过乳腺输送到乳汁的营养素是
A. 维生素B₁和锌
B. 维生素C和钙
C. 叶酸和铁
D. 维生素D和铁
E. 维生素D和锌

正确答案：D。维生素D和铁